小指尺掌侧动脉发自
A. 桡动脉
B. 尺动脉
C. 掌浅弓
D. 掌深弓
E. 指掌侧总动脉

正确答案：C。掌浅弓

解析：掌浅弓（C对）发出小指尺掌侧动脉和三条指掌侧总动脉。